男，27岁，牙龈疼痛，自动出血3天。检查：腐败性口臭，多个牙的牙龈乳头尖端消失变平，下切牙的龈缘虫蚀状坏死，有灰白膜覆盖。该病的最可能诊断是
A. 边缘性龈炎
B. 增生性龈炎
C. 急性坏死性龈炎
D. 慢性牙周炎
E. 快速进展性牙周炎

正确答案：C。急性坏死性龈炎

解析：本题考查急性坏死性溃疡性龈炎的临床表现。由病例描述，起病急，病程短（3天），牙龈自动出血，腐败性口臭，牙龈乳头消失呈刀切状，下前牙龈缘虫蚀状坏死，假膜覆盖，可考虑诊断为急性坏死性龈炎（C对）。边缘性龈炎（A错）发展较慢，龈缘也不会有虫蚀状坏死和龈乳头消失呈刀切状。增生性龈炎（B错）主要表现为牙龈的增生而不是坏死缺损。慢性牙周炎（D错）主要表现为牙周袋形成和牙槽骨吸收，牙龈不会呈虫蚀状坏死，龈乳头也不会消失呈刀切状。快速进展性牙周炎（E错）主要表现为牙槽骨的快速吸收，病程进展快，牙龈不会呈虫蚀状坏死。